产后乳汁正常,与家人生气后,乳汁骤减,乳汁稠,乳房胀硬而痛,精神抑郁,胸胁胀痛,食欲减退,舌暗红,苔薄黄,脉弦数。其诊断是
A. 缺乳气血虚弱证
B. 缺乳肝郁气滞证
C. 缺乳痰浊阻滞
D. 乳痈
E. 产后抑郁肝郁气滞

正确答案：B。缺乳肝郁气滞证

解析：题干中患者产后乳汁正常,与家人生气后,乳汁骤减,乳汁稠,乳房胀硬而痛,精神抑郁,胸胁胀痛,食欲减退,舌暗红,苔薄黄,脉弦数符合缺乳肝郁气滞证（B对）。缺乳气血虚弱证主要证候:产后乳汁少甚或全无，乳汁稀薄，乳房柔软无胀感;面色少华，倦怠乏力;舌淡苔薄白，脉细弱（A错）。缺乳痰浊阻滞主要征候:乳汁甚少或无乳可下，乳房硕大或下垂不胀满，乳汁不稠;形体肥胖，胸闷痰多，纳少便溏，或食多乳少;舌淡胖，苔腻，脉沉细（C错）。乳痈是发生于乳房部的急性化脓性疾病，常发生于哺乳期妇女，西医称为急性乳腺炎（D错）。产后抑郁肝郁气滞表现为产后精神抑郁，神志不安，或烦躁易怒，夜不入寐，或噩梦纷纭，惊恐易醒，胸闷纳呆，善太息，苔薄，脉弦（E错）。